某地连续三年统计肝癌死亡情况，以判断肝癌的严重程度，较合理的指标是
A. 粗死亡率
B. 年龄标化死亡率
C. 性别标化死亡率
D. 病死率
E. 地区标化死亡率

正确答案：D。病死率

解析：本题考查病死率的应用。病死率表示一定时期内因某病死亡者占该病病人的比例，表示某病病人因该病死亡的危险性。病死率（D对ABCE错）表示确诊某病者的死亡概率，它可反映疾病的严重程度。